A省药品生产企业生产某种第二类精神药品，为扩大药品销售量，在B省杂志上发布了该药品的广告，根据《广告法》，对该杂志社处以罚款的部门是
A. A省的药品监督管理部门
B. B省的药品监督管理部门
C. A省的市场监督管理部门
D. B省的市场监督管理部门
E. B省的新闻出版管理部门

正确答案：D。B省的市场监督管理部门

解析：本题考查违反药品广告管理的处罚。A省药品生产企业生产某种第二类精神药品，为扩大药品销售量，在B省杂志上发布了该药品的广告，根据《广告法》，对该杂志社处以罚款的部门是B省的市场监督管理部门（D对）。不得宣传发布的药品广告违反药品广告管理的处罚：使用或者变相使用国家机关、国家机关工作人员、军队单位、军队人员的名义和形象，利用军队装备、设施等从事广告宣传，或者对不得发布广告而进行广告宣传，以及未在指定刊物是发布处方药广告的，按照《广告法》第五十七条处罚，由市场监督管理部门责令停止发布广告，对广告主处二十万元以上一百万元以下的罚款，情节严重的，并可以吊销营业执照，由广告审查机关撤销广告审查批准文件、一年内不受理其广告审查申请；对广告经营者、广告发布者，由市场监督管理部门没收广告费用，处二十万元以上一百万元以下的罚款，情节严重的，并可以吊销营业执照、吊销广告发布登记证件。